实行政府定价的药品仅限于
A. 生产、经营具有垄断性的药品
B. 所有中成药
C. 所有二类精神药品
D. 列入国家《医保目录》的药品
E. 所以名族药

正确答案：A、D。生产、经营具有垄断性的药品；列入国家《医保目录》的药品

解析：本题考查药品定价。实行政府定价的药品仅限于生产、经营具有垄断性的药品（A对），列入国家《医保目录》的药品（D对）。《中华人民共和国药品管理法实施条例》规定国家对药品价格实行政府定价、政府指导价或者市场调节价。列入国家基本医疗保险药品目录的药品以及国家基本医疗保险药品目录以外具有垄断性生产、经营的药品，实行政府定价或者政府指导价；对其他药品，实行市场调节价。